上行性感染的肾盂肾炎病变最轻的部位是
A. 肾小管
B. 肾间质
C. 肾盂黏膜
D. 肾乳头
E. 肾小球

正确答案：E。肾小球

解析：上行性感染是引起肾盂肾炎的主要途径，肾小球通常较少受累（E对），病变最轻。肾小管（A错）、肾间质（B错）、肾盂粘膜 （C错）和肾乳头（D错）均较常受累，病变较重。